某男，56岁。患冠心病多年，3小时前突然出现下肢剧烈疼痛，行走困难，局部皮肤苍白，查体双下肢股动脉搏动消失，双股以下皮温低，肌力4级，诊断为
A. 血栓闭塞性脉管炎
B. 髂股动脉栓塞
C. 动脉硬化性动脉闭塞症
D. 糖尿病性动脉闭塞
E. 大动脉炎

正确答案：B。髂股动脉栓塞

解析：中年男性患者，多年冠心病史。突发下肢剧烈疼痛，局部皮肤苍白。双下肢股动脉搏动消失（提示梗阻平面在髂动脉分叉以上），双股以下皮温低，肌力4级，诊断为髂股动脉栓塞（B对）。急性动脉栓塞的典型表现可概括为5P征，即疼痛、感觉异常、麻痹、无脉和苍白。血栓闭塞性脉管炎（P489）（A错）多见于有吸烟嗜好的青壮年男性，进展缓慢，早期表现为患肢感觉异常及疼痛，随病变进展可出现间歇性跛行及静息痛。动脉粥样硬化性动脉闭塞症（P487）（C错）多见于45岁以上人群，进展缓慢，早期表现为患肢麻木、发凉及色泽苍白，随病变发展可出现间歇性跛行及静息痛。糖尿病性动脉闭塞（D错）多累及微动脉，常见于视网膜、肾、肌肉、神经等组织，且进展较慢。大动脉炎（P491）（E错）好发于青年女性，是主动脉及其分支的慢性、多发性、非特异性炎症，造成罹患动脉狭窄或闭塞，其临床症状视累及动脉不同而各异，常有低热、乏力、肌肉或关节疼痛、病变血管疼痛以及结节红斑等症状。